关于义齿基托树脂，下列描述错误的是
A. 自凝树脂可用于制作腭护板
B. 自凝树脂的力学性能整体上不如热凝树脂
C. 冬天为加快热凝树脂面团期的形成，可将调和物放在火焰上加热
D. 自凝树脂调和后，一般在糊状期塑形
E. 自凝树脂残余单体量较热凝树脂高

正确答案：C。冬天为加快热凝树脂面团期的形成，可将调和物放在火焰上加热

解析：本题考查义齿基托树脂。树脂具有可燃性，不能直接将调和物放在火焰上加热（C错，为本题的正确答案），有可能会燃烧。自凝树脂主要用于制作正畸活动矫治器、腭护板（A对）、牙周夹板、个别托盘、暂时冠桥以及义齿重衬等，也可用于制作简单义齿的急件。自凝树脂的力学性能整体上不如热凝树脂（B对），韧性较差，脆性较大，刚性较好。自凝树脂的调和物呈稀糊状时，可用糊塑法直接在湿模型上塑形（D错），此期流动性好，不黏丝，不粘器具，容易塑形。自凝树脂的残留单体含量多于热凝树脂基托（E对），热凝注射成型义齿基托树脂的残留单体含量极少，溶出物也非常少。